下列哪项不是根管预备的注意事项
A. 按工作长度操作
B. 器械只应到达根尖狭窄部
C. 用根管扩大针或锉时，应逐号进行
D. 每换一支器械前，应行根管冲洗
E. 根管应尽量扩大为好

正确答案：E。根管应尽量扩大为好

解析：临床普遍采用的标准是主锉应比初锉大2～3号，至少应扩大至25号，便于彻底清除根管内的感染物并利于根管充填。掌握“根管清理与成形”知识点。